一次肺癌研究中，一名医生访视200名病例，一名护士访视200名对照人群，病例组和对照组来自同一所医院，并按性别、年龄、种族进行配比，结果发现50%的肺癌患者是重度吸烟者，而对照组仅30%是重度吸烟者，差别有统计学意义，有人据此得出结论，肺癌与重度吸烟有联系，此推论
A. 正确
B. 不正确，因为不是根据率来判断
C. 不正确，因为病例组和对照组在有关的特征上不可比
D. 不正确，因为对统计学意义的解释不确切
E. 不正确，因为可能存在观察偏倚

正确答案：E。不正确，因为可能存在观察偏倚